营养就是
A. 多摄入各种有利于健康的食物
B. 机体从外界摄取食物为满足自身的生理需要
C. 为了健康和生长发育，多吃营养品，滋补品
D. 机体从外界摄取食物以满足自身生理需要所必需的生物学过程
E. 多吃营养品，滋补品，提高机体的抵抗力和免疫力

正确答案：D。机体从外界摄取食物以满足自身生理需要所必需的生物学过程

解析：营养指人体摄取、消化、吸收、利用食物中的营养物质以满足机体生理需要的生物学过程。掌握“合理营养指导”知识点。